前牙单面嵌体应采用
A. Ⅰ型金合金
B. Ⅱ型金合金
C. Ⅲ型金合金
D. Ⅳ型金合金
E. 镍铬合金

正确答案：A。Ⅰ型金合金

解析：本题考查各型合金的用途。前牙单面嵌体应采用Ⅰ型金合金（A对）。各型合金的用途：（1）1型合金用于承受低应力的单个牙齿的固定修复体，如单面嵌体和带有瓷饰面的单个冠。（2）2型合金（B错）用于所有单个牙齿的固定修复体，如涉及多个牙面的嵌体和无饰面的冠。（3）3型合金（C错）用于多个单位的固定修复体，例如固定桥。（4）4型合金（D错）用于承受极高应力的、断面较薄的修复体，例如可摘局部义齿、卡环、较薄的饰面冠、跨度大的或横截面小的桥体、杆、附着体以及种植体的上部结构。（5）5型合金用于需要高刚性和高强度的修复体，例如薄的可摘局部义齿、薄的卡环等。